对准备从事接尘作业职工进行就业前体检时，下列项目中哪个是不必要进行的检查项目
A. 职业史
B. 既往史和自觉检查
C. 一般临床检查
D. B超检查
E. 拍摄胸片

正确答案：D。B超检查